心悸，善惊易恐，多梦易醒，口苦咽干。其证型是
A. 心脾两虚
B. 心肝失调
C. 心肾不交
D. 心虚胆怯
E. 心阴亏虚

正确答案：D。心虚胆怯

解析：惊则气乱，心神不能自主，则心悸，多有诱因；心不藏神故善惊易恐，多梦易醒，口苦咽干为心火上炎所致，故可诊断为心虚胆怯证（D对）。心脾两虚证（A错）表现为心悸，面色苍白，头晕乏力，倦怠懒言。心肝失调证（B错）表现为心悸，胸胁胀痛，症状随情绪波动而变化，性急易怒。心肾不交证（C错）表现为心烦失眠，头晕目眩，耳鸣腰酸，舌红少苔或无苔，脉细数。心阴亏虚证（E错）表现为心悸盗汗，虚烦不寐，舌红少苔，脉细数。